将氯霉素注射液加入5%葡萄糖注射液中，氯霉素从溶液中析出
A. 药理学的配伍变化
B. 给药途径的变化
C. 适应证的变化
D. 物理学的配伍变化
E. 化学的配伍变化

正确答案：D。物理学的配伍变化

解析：本题考查药物的配伍变化。将氯霉素注射液加入5%葡萄糖注射液中，氯霉素从溶液中析出为物理学的配伍变化（D对）。某些溶剂性质不同的制剂相互配合使用时，常因药物在混合后的溶液体系中的溶解度较小而析出沉淀。氯霉素注射液（含乙醇、甘油或丙二醇等）加入5%葡萄糖注射液中时往往析出氯霉素属于物理学的配伍变化。阿莫西林与克拉维酸钾制成复方制剂时抗菌疗效最强属于药理学配伍变化（A错）。化学的配伍变化（E错）系指药物之间发生了化学反应而导致药物成分的改变，产生沉淀、变色、产气、发生爆炸等现象，以致影响到药物制剂的外观、质量和疗效，或产生毒副作用。如多巴胺注射液与碳酸氢钠注射液配伍会渐变成粉红至红色属于化学配伍变化。